石膏的主治病证有
A. 气分高热
B. 肺热咳喘
C. 湿热黄疸
D. 胃火牙痛
E. 水火烫伤

正确答案：A、B、D、E。气分高热；肺热咳喘；胃火牙痛；水火烫伤

解析：本题考查的是石膏的主治病证。石膏的主治病证有气分高热（A对）、肺热咳喘（B对）、胃火牙痛（D对）与水火烫伤（E对）。石膏：【主治病证】（1）温病气分高热。（2）肺热咳喘。（3）胃火上炎所致的头痛、牙龈肿痛、口舌生疮。（4）疮疡不敛，湿疹，水火烫伤，外伤出血。栀子：【主治病证】（1）热病心烦、郁闷、躁扰不宁。（2）湿热黄疸（C错），热淋，血淋。（3）血热吐血、衄血、尿血。（4）热毒疮肿，跌打肿痛。